产生黄曲霉毒素的真菌主要有
A. 寄生曲霉
B. 杂色曲霉
C. 烟曲霉
D. 构巢曲霉
E. 以上都不是

正确答案：A。寄生曲霉